因果推断中的必要条件是
A. 因先后果
B. 关联强度大
C. 关联可重复出现
D. 存在剂量﹣反应关系
E. 病因和疾病分布一致

正确答案：A。因先后果